诸寒收引，皆属于
A. 肝
B. 心
C. 脾
D. 肺
E. 肾

正确答案：E。肾

解析：凡是寒病而发生的筋脉拘急，都属于肾。肾阳不足，寒从内生，脏腑、经络、筋脉、形体、诸窍、诸骸均失温养而见功能低下，气血运行迟缓，筋脉痉挛拘急、收引、疼痛（E对）。“诸风掉眩，皆属于肝”（A错）。“诸痛痒疮，皆属于心”（B错）。“诸湿肿满，皆属于脾”（C错）。“诸气膹郁，皆属于肺”（D错）。